交感神经节后神经元不在
A. 椎旁神经节
B. 颈上神经节
C. 肠系膜上神经节
D. 耳神经节
E. 腹腔神经节

正确答案：D。耳神经节

解析：周围部的副交感神经节，位于器官的周围或器官的壁内，称器官旁节和器官内节，节内的细胞即为节后神经元，位于颅部的副交感神经节较大，肉眼可见，有睫状神经节、下颌下神经节、翼腭神经节和耳神经节（D错，为本题正确选项）等。